下列不属于他汀类作用的是
A. 调血脂作用
B. 抑制血管平滑肌细胞的增殖
C. 抑制单核细胞-巨噬细胞的黏附
D. 抑制血小板聚集和提高纤溶活性
E. 增加动脉壁巨噬细胞形成

正确答案：E。增加动脉壁巨噬细胞形成

解析：他汀类尚具有下列作用：①调血脂作用；②改善血管内皮功能，提高血管内皮对扩血管物质的反应性；③抑制血管平滑肌细胞（VSMCs）的增殖和迁移，促进VSMCs凋亡；④减少动脉壁巨噬细胞及泡沫细胞的形成，使动脉粥样硬化斑块稳定和缩小；⑤降低血浆C反应蛋白，减轻动脉粥样硬化过程的炎性反应；⑥抑制单核细胞-巨噬细胞的黏附和分泌功能；⑦抑制血小板聚集和提高纤溶活性等。这些作用亦有助于抗动脉粥样硬化。掌握“抗动脉粥样硬化药”知识点。